急性呼吸窘迫综合症患者接受气管插管、机械通气治疗时，为改善氧合，最主要的措施是
A. 延长呼吸比
B. 增加呼气末正压通气水平
C. 增加压力控制通气的预设压力水平
D. 增加吸氧浓度
E. 增加潮气量

正确答案：B。增加呼气末正压通气水平

解析：ARDS主要病理特征是透明膜形成，导致弥散功能障碍，患者出现顽固的低氧血症，因此需采取呼气末正压通气（PEEP）（B对）来提高肺泡内气体交换。延长呼吸比（A错）、增加潮气量（E错）、增加吸氧浓度（D错）可提高PaO₂，但是多数患者需使用机械通气。增加压力控制通气的预设压力水平（C错）可以增加肺泡气体交换量，但仍需要呼气末正压通气来减少肺透明膜的形成。